前瞻性队列研究
A. 不适于发病率很低的疾病的病因研究
B. 不适于罕见暴露和疾病关系的病因研究
C. 不适于一果多因的研究
D. 目前确证暴露和疾病的因果关系最好的设计
E. 收集到的资料可能缺少需要的细目

正确答案：A。不适于发病率很低的疾病的病因研究

解析：本题考查前瞻性队列研究的选用原则。选择前瞻性队列研究，应重点考虑：1.应有明确的检验假设，检验的因素必须找准；2.所研究疾病的发病率或者死亡率较高（A对BCDE错），如不低于5‰；3.应明确规定暴露因素，并且应有把握获得观察人群的暴露资料；4.应明确规定结局变量，如发病或死亡，并且要有规定结局的简便而可靠的手段；5.应有把握获得足够的观察人群，并将其清楚的分成暴露组和非暴露组；6.大部分观察人群应能被长期随访下去，并获得可靠完整的资料；7.应有足够的人力、财力和物力支持该项工作。